关于甲型肝炎地区分布下列哪项是正确的
A. 地区分布极不平衡，相差很悬	殊，高度地方性流行区主要在地中海沿岸等地
B. 地方性流行区主要是南亚、南	美、非洲等地区，西方国家主要为散发或输入性病例
C. 流行与卫生水平关系很大，西	方国家抗体流行率较低，发展中国家较高
D. 世界分布很不平衡，我国病毒	携带率南方高于北方，农村高于城市
E. 世界上抗体流行率虽不平衡，	但相差不特别悬殊

正确答案：C。流行与卫生水平关系很大，西	方国家抗体流行率较低，发展中国家较高

解析：本题考查甲型肝炎的分布。甲型肝炎的流行与卫生水平关系很大，西方国家抗体流行率较低，发展中国家较高（C对）。甲型肝炎的高度地方性流行区主要是在亚洲的印度尼西亚、泰国、斯里兰卡和马来西亚等（A错）。HAV基因型和亚型呈现明显的地区分布差异特征，Ⅰ型在世界范围内流行最为广泛。ⅠA型主要流行于亚洲、美洲和欧洲等地区,ⅠB型主要流行于中东和南非,Ⅱ型主要局限于非洲部分地区（B错）。甲型肝炎的世界分布不平衡，各个不同的地区，相差可非常悬殊（E错），我国病毒携带率农村高于城市，西南西北地区的携带率较高（D错）。